高温作业指工作地点有生产性热源，其气温等于或高于本地区夏季室外通风设计计算温度多少的作业
A. 0.2℃
B. 0.2℃以上
C. 1℃
D. 1℃以上
E. 2℃

正确答案：E。2℃

解析：本题考查旧版教材高温作业的概念。高温作业指工作地点有生产性热源，其气温等于或高于本地区夏季室外通风设计计算温度2℃（E对ABCD错）的作业。